男，60岁，直肠癌切除术后4天，晨起时突发左下肢肿胀，左腿皮温增高，股三角区有深压痛。最有可能的诊断是左下肢
A. 血栓性浅静脉炎
B. 动脉栓塞
C. 深静脉血栓形成
D. 大隐静脉曲张
E. 淋巴水肿

正确答案：C。深静脉血栓形成

解析：老年男性患者，直肠癌切除术后4天（手术后血液处于高凝状态；术后需卧床，导致下肢静脉血流缓慢，容易引起下肢深静脉血栓形成）。晨起时突发左下肢肿胀，左腿皮温增高，股三角区有深压痛（下肢深静脉血栓形成的典型表现）。综合该患者的病史及体查，最有可能的诊断是左下肢深静脉血栓形成（C对）。血栓性浅静脉炎（A错）病变静脉区呈红肿索条状，伴有明显疼痛和压痛，局部皮温升高。动脉栓塞（P490）（B错）起病急骤，进展迅速，主要表现为疼痛、感觉异常、麻痹、无脉和苍白。大隐静脉曲张（D错）主要表现为大隐静脉扩张、迂曲，下肢沉重与乏力感，可有踝部轻度肿胀和足靴区皮肤营养性变化（如皮肤色素沉着、皮炎、湿疹）。淋巴水肿（P507）（E错）主要表现为自肢体远端向近端扩展的慢性进展性无痛性水肿，可伴有皮肤增厚、皮温略增高等改变。